根据药品不良反应的性质分类，与药物本身药理作用无关的不良反应包括
A. 副作用
B. 毒性反应
C. 后遗效应
D. 变态反应
E. 特异质反应

正确答案：D、E。变态反应；特异质反应

解析：本题考查药品不良反应。根据药品不良反应的性质分类，与药物本身药理作用无关的不良反应包括变态反应（D对）、特异质反应（E对）。变态反应是指机体受药物刺激所引起的异常免疫反应，引起机体生理功能障碍或组织损伤。变态反应常见于过敏体质患者，反应性质与药物原有效应和剂量无关，用药理性拮抗药解救无效。特异质反应是指少数特异体质患者对某些药物反应异常敏感。特异质反应多是先天遗传异常所致的反应。副作用（A错）是指在药物按正常用法用量使用时，出现的与治疗目的无关的不适反应。毒性反应（B错）是指在药物剂量过大或体内积蓄过多时发生的危害机体的反应。后遗效应（C错）是指在停药后血药浓度已降至最低有效浓度以下时仍残留的药理效应。